芩连片主治脏腑蕴热所致的头痛目赤、口鼻生疮、疮疖肿痛，其功能是
A. 清热泻火解毒，化瘀凉血止血
B. 清胃泻火，化瘀消肿
C. 清热泻火，散风止痛
D. 清热泻火，利尿通便
E. 清热解毒，消肿止痛

正确答案：E。清热解毒，消肿止痛

解析：本题考查的是芩连片的功能。芩连片主治脏腑蕴热所致的头痛目赤、口鼻生疮、疮疖肿痛，其功能是清热解毒，消肿止痛（E对）。芩连片：【功能】清热解毒，消肿止痛。一清颗粒：【功能】清热泻火解毒，化瘀凉血止血（A错）。牛黄上清丸：【功能】清热泻火，散风止痛（C错）。导赤丸：【功能】清热泻火，利尿通便（D错）。